某医师根据肺为娇脏喜润恶燥之特点，在治疗咳嗽痰喘的处方中常将紫菀与款冬花相须为用。此因二者除均能润肺下气外，又均能
A. 润肠通便
B. 降逆止呕
C. 清肠疗痔
D. 化痰止咳
E. 纳气平喘

正确答案：D。化痰止咳

解析：本题考查的是紫菀与款冬花的功效。常将紫菀与款冬花相须为用。此因二者除均能润肺下气外，又均能化痰止咳（D对）。紫菀：【功效】润肺下气，化痰止咳。款冬花：【功效】润肺下气，止咳化痰。紫苏子：【功效】降气化痰，止咳平喘，润肠通便（A错）。旋覆花：【功效】消痰行水，降气止呕（B错）。马兜铃：【功效】清肺化痰，止咳平喘，清肠疗痔（C错）。磁石：【功效】镇惊安神，平肝潜阳，聪耳明目，纳气平喘（E错）。